吗啡的药理作用有
A. 抑制机体免疫功能
B. 兴奋平滑肌
C. 抑制延脑催吐化学感受区
D. 抑制脑干呼吸中枢
E. 镇痛

正确答案：A、B、D、E。抑制机体免疫功能；兴奋平滑肌；抑制脑干呼吸中枢；镇痛

解析：本题考查吗啡。吗啡为阿片受体激动剂。其药理作用为：镇痛（E对）：强大的镇痛作用，对一切疼痛均有效；镇静；呼吸抑制：可抑制呼吸中枢（D对）；镇咳：可抑制咳嗽中枢；使消化道平滑肌兴奋（B对），致便秘；使外周血管扩张、血压下降；使脑血管扩张，颅压增高；催吐（C错）；对免疫系统有抑制作用（A对）。